脊神经前、后根合成部位是在
A. 横突孔处
B. 椎孔内
C. 椎间孔处
D. 椎管内
E. 骶管裂孔处

正确答案：C。椎间孔处

解析：脊神经前根和后根在椎间孔处（C对）合为一条脊神经。